区别血红蛋白尿与血尿的主要方法是
A. 尿比重
B. 尿胆红素
C. 尿蛋白电泳
D. 尿沉渣镜检
E. 尿蛋白定性试验

正确答案：D。尿沉渣镜检

解析：血红蛋白尿是尿液中存在血红蛋白，血尿是尿液中RBC≥3个/HP，当出血量超过1ml/L时，尿液可呈现淡红色、洗肉水乃至血样尿，此时称为肉眼血尿，故无法通过观察血尿颜色来区别二者，同时尿潜血试验(尿隐血试验）是通过干化学法测定尿液中的血红蛋白，故血红蛋白尿和血尿都会显示出阳性。尿液的有形成分主要指来自泌尿道，并以可见形式渗出、排出、脱落和浓缩结晶所形成的有形物质，即“尿沉渣”，常见尿液中的有形成分主要包括：细胞类、管型类、结晶类、寄生虫及其他，尿残渣检查(D对）是通过观察尿液不离心或离心后沉渣中的有形成分来进行实验诊断，当血尿时候可以观察到尿液中的红细胞(可因红细胞来源、尿液pH及渗透压的影响发生不同变化），而血红蛋白尿中是观察不到红细胞的，因此尿沉渣检查可用于血红蛋白尿与血尿的鉴别。